在牙齿的外源性酸蚀中，以下哪种因素为常见因素
A. 呼吸道疾病
B. 神经性疾病
C. 外伤
D. 运动因素
E. 饮食因素

正确答案：E。饮食因素

解析：外源性酸蚀：饮食因素在牙酸蚀症的发病中占重要地位，各类酸性水果、果汁、各种碳酸类饮料等与牙酸蚀症的发生发展密切相关。掌握“酸蚀症的预防”知识点。